粉尘中的二氧化硅与致纤维化能力的关系是
A. 游离型致纤维化作用与结合型相同
B. 游离型致纤维化作用大于结合型
C. 游离型致纤维化作用小于结合型
D. 结晶型致纤维化小于非结晶型
E. 以上全对

正确答案：B。游离型致纤维化作用大于结合型

解析：本题考查粉尘中的二氧化硅与致纤维化能力的关系。粉尘中游离SiO₂含量越高，发病时间越短，病变越严重。因此，粉尘中的二氧化硅与致纤维化能力的关系是游离型致纤维化作用大于结合型（B对ACDE错）。